可复性牙髓炎对下列哪项检查最敏感
A. 温度测试
B. 探诊
C. 咬诊
D. 叩诊
E. 酸甜刺激

正确答案：A。温度测试

解析：可复性牙髓炎受到温度刺激尤其是冷刺激时，产生短暂、尖锐的疼痛，当刺激除去后，疼痛很快消失或仅延续数秒钟。“一过性敏感”。测试时立即出现一过性疼痛反应，刺激去除后疼痛持续数秒后消失，结合病史无自发痛，表示此时牙髓可能处于可复性炎症状态。掌握“可复性、急慢性牙髓炎”知识点。